成牙本质空泡变性的原因除了以下哪一点
A. 牙髓供血不足
B. 细菌及毒素刺激
C. 洞型制备创伤
D. 充填材料刺激
E. 光照刺激

正确答案：E。光照刺激

解析：本题考查牙髓变性。成牙本质空泡变性的原因除了光照刺激（E错，为本题正确答案）。 成牙本细胞空泡变性常常是由于牙髓供血不足（A对）、细菌及毒素刺激（B对）、洞型制备的创伤（C对）或充填材料的刺激（D对）等所引起。